艾滋病抗病毒治疗强调须多种药物联合治疗，俗称“鸡尾酒疗法”，目前国内免费治疗的一线方案是
A. 拉米夫定+替诺福韦+齐多夫定
B. 替诺福韦+依非韦伦+雷特格韦
C. 齐多夫定+依非韦伦+利托那韦
D. 拉米夫定+司他夫定+奈韦拉平
E. 恩替卡韦+奈韦拉平+利托那韦

正确答案：D。拉米夫定+司他夫定+奈韦拉平

解析：本题考查艾滋病治疗方案。目前国内免费治疗艾滋病的一线方案为拉米夫定+司他夫定+奈韦拉平（D对）。艾滋病抗病毒治疗强调多种药物联合治疗，俗称“鸡尾酒疗法”。但尚不能彻底清除病毒，患者需要终生用药。拉米夫定+司他夫定+奈韦拉平是目前国内免费治疗的一线方案。